成釉细胞纤维瘤最好发的部位是
A. 上颌磨牙区
B. 上颌尖牙区
C. 下颌前牙区
D. 下颌磨牙区
E. 上颌尖牙区

正确答案：D。下颌磨牙区

解析：成釉细胞纤维瘤多见于儿童和青年成人，最常见的部位是下颌磨牙区。掌握“牙源性腺样瘤、成釉细胞纤维瘤”知识点。